鼠李糖是
A. 五碳醛糖
B. 六碳醛糖
C. 甲基五碳醛糖
D. 六碳酮糖
E. 糖醛酸

正确答案：C。甲基五碳醛糖

解析：本题考查的是糖类的结构分类。鼠李糖是甲基五碳醛糖（C对）。单糖是多羟基醛或酮，是组成糖类及其衍生物的基本单元。常与苷元连接的单糖有：1.五碳醛糖（A错）：木糖、阿拉伯糖、核糖。2.六碳醛糖（B错）：葡萄糖、甘露糖、半乳糖。3.甲基五碳醛糖：鸡纳糖、鼠李糖、夫糖。4.六碳酮糖（D错）：果糖。5.糖醛酸（E错）：葡萄糖醛酸、半乳糖醛酸。